《医疗废物管理条例》的实施时间是
A. 2003年6月16日
B. 2003年7月16日
C. 2004年6月16日
D. 2004年7月16日
E. 2005年7月16日

正确答案：A。2003年6月16日